患儿，男，1岁。B型超声检查发现左侧睾丸位于腹股沟管内。经内分泌治疗10周后睾丸仍未下降到阴囊内。下一步治疗的最佳方法是
A. 观察
B. 左睾丸切除术
C. 继续内分泌治疗
D. 近期行左睾丸下降固定术
E. 3岁后行左睾丸下降固定术

正确答案：D。近期行左睾丸下降固定术

解析：患儿经B超检查发现左侧睾丸位于腹股沟管内，应诊断为左侧隐睾症。经内分泌治疗10周后睾丸仍未下降到阴囊内，为避免睾丸长时间位于腹股沟管内影响睾丸功能，下一步治疗的最佳方法是近期行左睾丸下降固定术（D对）。观察（A错）、继续内分泌治疗（C错）对该患儿病情的缓解意义不大，且易延误最佳手术治疗时机，影响患儿预后。左睾丸切除术（B错）适用于睾丸萎缩且不能被拉下并置入阴囊而对侧正常者。3岁后行睾丸下降固定术（E错）易致患儿不育且发生睾丸恶性肿瘤的几率增大。